郁证，证属心脾两虚的临床表现是
A. 头晕神疲
B. 多思善疑
C. 心悸胆怯
D. 胁胀脘闷
E. 胸部痞满

正确答案：A、B、C。头晕神疲；多思善疑；心悸胆怯

解析：本题考查的是郁证的辨证论治。郁证，证属心脾两虚的临床表现是头晕神疲（A对）、多思善疑（B对）与心悸胆怯（C对）。郁证心脾两虚证：【症状】情绪不宁，多思善疑，头晕神疲，心悸胆怯，失眠健忘，食少纳呆，面色不华。舌质淡，苔薄白，脉细。